面神经丘深部为
A. 孤束核
B. 展神经核
C. 面神经核
D. 舌下神经核
E. 迷走神经背核

正确答案：B。展神经核

解析：展神经核（B对）位于脑桥下部，面神经丘的深面；孤束核（A错）位于延髓内界沟外侧，迷走神经背核的腹外侧，上端可达脑桥下端，下端至内侧丘系交叉平面；面神经（C错）位于脑桥下部，被盖腹 外侧的网状结构内，展神经核的腹外侧；舌下神经核（D错）核呈柱状，位于延髓上部，舌下神经三角的深面；迷走神经背核（E错）位于延髓迷走神经三角的深面，舌下神经核的背外侧。